与肾小球滤过作用无关的因素是
A. 肾血浆流量
B. 有效滤过压
C. 滤过膜面积
D. 滤过通透性
E. 肾髓质渗透压梯度

正确答案：E。肾髓质渗透压梯度